下列选项中属于现代医学模式出现的主要历史背景是
A. 传染病的发生、流行与死亡日益突出
B. 慢性非传染疾病的发生、死亡日益突出
C. 工业化、都市化带来的公共性问题
D. 基础医学的发展
E. 预防医学的发展

正确答案：B。慢性非传染疾病的发生、死亡日益突出

解析：本题考查现代医学模式出现的主要历史背景。现代医学模式出现的主要历史背景是慢性非传染疾病的发生、死亡日益突出（B对ACDE错）。